面神经核上瘫与核下瘫的区别
A. 口角下垂
B. 鼻唇沟变浅
C. 两侧额纹正常
D. 不能鼓腮
E. 表情消失

正确答案：C。两侧额纹正常

解析：面神经核上瘫与核下瘫的区别为核上瘫两侧额纹正常，而核下瘫两侧额纹消失（C对）。而核上瘫和核下瘫均会造成口角下垂（A错）、鼻唇沟变浅（B错）、不能鼓腮（D错）、表情消失（E错）。